因含罂粟壳而不能过量或长期服用的中成药是
A. 川贝止咳露
B. 强力枇杷露
C. 急支糖浆
D. 蜜炼川贝枇杷膏
E. 蛇胆川贝散

正确答案：B。强力枇杷露

解析：本题考查的是强力枇杷露的注意事项。因含罂粟壳而不能过量或长期服用的中成药是强力枇杷露（B对）。强力枇杷露：【注意事项】因其含有毒的罂粟壳，故不可过量服用或久用。孕妇、哺乳期妇女及儿童慎用强力枇杷露，禁用强力枇杷胶囊。外感咳嗽及痰浊壅盛者慎用。服药期间，忌食辛辣厚味食物。川贝止咳露（A错）：【注意事项】风寒咳嗽者慎用。服药期间，忌烟、酒及辛辣食物。急支糖浆（C错）：【注意事项】孕妇及寒证者慎用。因其含麻黄，故运动员、心脏病患者、高血压病患者慎用。服药期间，忌食辛辣、生冷、油腻食物，忌吸烟饮酒。蜜炼川贝枇杷膏（D错）：【注意事项】外感风寒咳嗽者慎用。服药期间忌食辛辣食物。蛇胆川贝散（E错）：【注意事项】孕妇慎用。痰湿犯肺或久咳不止者慎用。服药期间，忌食辛辣、油腻食物，忌吸烟、饮酒。